关于巢式病例对照研究，下列哪种说法是错误的
A. 是将队列研究与病例对照研究相结合的方法
B. 暴露与疾病的时间先后顺序清楚
C. 病例组与对照组可比性好
D. 不能提高统计检验效率
E. 可以避免回忆偏倚

正确答案：D。不能提高统计检验效率